细菌经紫外线照射会发生DNA损伤，为修复这种损伤，细菌合成DNA修复酶的基因表达增强，这种现象称为
A. DNA损伤
B. DNA修复
C. DNA表达
D. 诱导
E. 阻遏

正确答案：D。诱导

解析：可诱导基因在一定的环境中表达增强的过程称为诱导（D对），例如细菌经紫外线照射会发生DNA损伤，为修复这种损伤，细菌合成DNA修复酶的基因表达增强；如果基因对环境信号应答时被抑制，这种基因称为可阻遏基因，可阻遏基因表达产物水平降低的过程称为阻遏（E错）。诱导和阻遏是同一事物的两种表现形式，在生物界中普遍存在，是生物体适应环境的基本途径。DNA损伤（A错）指各种因素造成的DNA组成与结构的变化；DNA修复（B错）是指纠正DNA两条单链间错配的碱基、清除DNA链上受损的碱基或糖基、恢复DNA的正常结构的过程。DNA损伤与DNA修复是细胞内DNA复制中并存的过程。DNA表达（C错）是DNA转录和翻译的过程，可产生具有特定生物学功能的蛋白质分子。